男，40岁。10年前发现乙型肝炎表面抗原阳性，未规律诊治。近日食欲下降。肝穿刺可见假小叶，其正确的诊断是
A. 肝癌
B. 慢性乙型肝炎
C. 肝结核
D. 肝淋巴瘤
E. 乙肝肝硬化

正确答案：E。乙肝肝硬化

解析：中年男性患者，10年前发现乙型肝炎表面抗原阳性（提示有乙肝），近日食欲下降（肝功能减退的表现），肝穿刺见假小叶（假小叶为肝硬化的典型病理形态），可诊断为肝硬化（E对）。肝癌（P415）（A错）、慢性乙型肝炎（B错）、肝结核（C错）及肝淋巴瘤（D错）均不会出现假小叶。